女，60岁。近1个月来失眠，入睡困难，感到孤独没有人关心，兴趣少，可能的诊断是
A. 帕金森病
B. 呼吸睡眠障碍
C. 失眠症
D. 抑郁症
E. 老年性痴呆

正确答案：E。老年性痴呆

解析：老年性痴呆现改称为阿尔茨海默病，是老年期最常见的痴呆类型。临床表现主要为记忆障碍、视空间障碍人格障碍等，患者还会因为记忆障碍等原因而表现出烦躁、焦虑、忧虑的表现，使得患者失眠，与亲人朋友沟通障碍而感到孤独、失去兴趣。本例患者老年女性，近1个月来失眠，入睡困难，感到孤独没有人关心，兴趣少，可诊断为老年性痴呆（现称为阿尔茨海默病）（E对）。帕金森病（A错）会有典型的静止性震颤、运动迟缓、肌强直和姿势平衡障碍表现。呼吸睡眠障碍（B错）会有睡眠中呼吸暂停现象。失眠症（C错）会有入睡困难、梦中惊醒等症状，临床症状以失眠为主，一般无孤独感。抑郁症（D错）常见于青中年患者，多由压力大、家庭、生活等因素引起，表现为情感低落、容易躁狂，甚至有自杀的意图。